促进造血干细胞增生分化的细胞因子是
A. IL-2
B. IFN-γ
C. IL-4
D. G-CSF
E. IL-10

正确答案：D。G-CSF

解析：集落刺激因子（CSF）是指能够刺激多能造血干细胞和不同分化发育阶段的造血祖细胞增殖与分化的细胞因子，主要包括粒细胞-巨噬细胞集落刺激因子（GM-CSF）、巨噬细胞集落刺激因子（M-CSF）、粒细胞集落刺激因子（G-CSF）（D对）、红细胞生成素（EPO）、干细胞因子（SCF）和血小板生成素（TPO）等。IL-2（A错）主要功能是刺激T细胞的生长和分化，激活NK细胞和巨噬细胞，促进CTL功能。IFN-γ（B错）是干扰素中的一型，主要可以干扰病毒的感染和复制。IL-4（C错）主要功能是刺激B细胞增殖，参与Th2细胞分化，促进嗜酸性粒细胞、嗜碱性粒细胞和肥大细胞发育，促进IgE生成。IL-10（E错）的主要功能是抑制活化的单核细胞产生细胞因子，抑制Th1细胞因子的产生，促进B细胞增殖。